患者，女，47岁，诊断为胆固醇性胆结石，宜使用的促进结石溶解的药物是
A. 熊去氧胆酸
B. 阿昔莫司
C. 考来烯胺
D. 猪去氧胆酸
E. 依折麦布

正确答案：A。熊去氧胆酸

解析：本题考查熊去氧胆酸的临床应用。熊去氧胆酸（A对）能降低胆汁内胆固醇的饱和度，脂类恢复微胶粒状态，从而使结石中的胆固醇溶解、脱落。